管理舌前2/3味觉的神经来自
A. 迷走神经
B. 三叉神经
C. 面神经
D. 舌咽神经
E. 无

正确答案：C。面神经

解析：迷走神经（A错）主要支分布于自胃至横结肠的消化管及肝、胰、脾、肾等实质性脏器。三叉神经（B错）主要主要传导咀嚼肌和眼外肌的本体感觉。面神经（C对）主要管理舌前2/3的味觉以及表情肌的运动。舌咽神经（D错）主要管理舌后1/3的味觉。